熟地的归经是
A. 肝肾
B. 肝脾
C. 心肝
D. 心脾
E. 肺脾

正确答案：A。肝肾

解析：本题考查的药物的归经。熟地归肝、肾（A对）经，性甘微温，具有补血养阴，填精益髓的功效。